某中学，有初中班和高中班。该学校的老师想用某指标对该校学生的发育年龄进行评价，以下指标中哪个最好
A. 身高年龄
B. 第二性征年龄
C. 体重年龄
D. 牙齿年龄
E. 以上方法均可，没有最好的指标

正确答案：B。第二性征年龄